一患者下颌双尖牙，活髓，全冠修复水门汀粘固后第2天出现自发痛，最可能的原因是
A. 牙本质敏感
B. 牙髓充血
C. 牙髓炎
D. 根尖周炎
E. 创伤（牙合）

正确答案：C。牙髓炎

解析：冠戴入后自发性疼痛原因：①其常见原因为牙髓炎、金属微电流刺激和根尖炎或牙周炎。②由于牙体切割过多，粘固前未戴暂时冠做牙髓安抚治疗，牙髓受刺激由充血发展为牙髓炎。③修复体戴用一段时间后出现的自发性疼痛，多见于继发龋引起的牙髓炎。④由于修复前根管治疗不完善，根尖周炎未完全控制。⑤根管侧壁钻穿未完全消除炎症。⑥咬合创伤引起的牙周炎。综上所述，患者双尖牙为活髓，戴入已两天最有可能为牙髓炎。掌握“修复体戴入后的问题及处理”知识点。